痰少而黏难咳者，多属
A. 寒痰
B. 湿痰
C. 风痰
D. 热痰
E. 燥痰

正确答案：E。燥痰

解析：本题考查的是望排出物的主要内容及临床意义。痰少而黏难咳者，多属燥痰（E对）。望痰涎的主要内容及临床意义：对痰涎来说，一般痰色白而清稀，多为寒证（A错）；痰色黄或白而黏稠者，多属热证（D错）。痰少极黏、难以排出者，多属燥痰；痰白易咳而量多者，为湿痰（B错）。咯吐脓血如米粥状，为热毒蕴肺，多是肺痈证；痰中带血，或咯吐鲜血，多为热伤肺络。